男，62岁。间隔咳嗽、咳痰10余年，喘息5年，加重3天入院。吸烟41年，30支/日，已戒5年。查体：烦躁，球结膜充血、水肿，口唇发绀。桶状胸，双肺呼吸音低，右下肺可闻及少许湿性啰音，肝肋下5cm，肝颈静脉回流征（+），双下肢水肿。血K⁺4.5mmol/L。Na⁺129mmol/L，Cl⁻90mmol/L。若该患者出现意识障碍，最可能的原因是
A. 感染中毒性脑病
B. 脑血管意外
C. 肝性脑病
D. 肺性脑病
E. 低钠血症

正确答案：D。肺性脑病

解析：患者为中老年男性，既往有吸烟病史，间隔咳嗽、咳痰、喘息，桶状胸（为慢阻肺的典型表现），提示慢阻肺（COPD）。烦躁，球结膜充血、水肿，口唇发绀，双肺呼吸音低，右下肺可闻及少许湿性啰音，肝肋下5cm，肝颈静脉回流征（+），双下肢水肿（为右心衰竭的表现），提示为由慢阻肺引起的肺源性心脏病。Na⁺129mmol/L（正常值135～145mmol/L），Cl⁻90mmol/L（正常值98～106mmol/L），电解质紊乱支持此诊断。该患者出现意识障碍，最可能的原因是由于缺氧和二氧化碳潴留导致的肺性脑病（D对）。感染中毒性脑病（A错）多见于儿童，表现为高热、严重头痛、呕吐、烦躁不安和谵妄乃至昏迷。脑血管意外（B错）发生的原因主要与脑血管的病变有关，即与高血脂、糖尿病、高血压、血管的老化、吸烟等密切相关，通常在活动和情绪激动时发病，出血前多无预兆，半数患者出现头痛并很剧烈，常见呕吐，出血后血压明显升高，临床症状常在数分钟至数小时达到高峰。肝性脑病（P408）（C错）的患者表现为意识障碍、行为失常和昏迷，其中大部分有肝硬化的病史，并且肝性脑病的发病常有消化道出血等诱因。患者Na⁺129mmol/L，血钠轻度降低，轻度低钠血症（E错）不会引起意识障碍。